患者女性，已确诊肝癌。1天前突然出现剧烈腹痛，休克，应首先考虑的并发症是
A. 原发性腹膜炎
B. 急性梗阻性化脓性胆管炎
C. 结核性腹膜炎
D. 原发性肝癌破裂
E. 肝性脑病

正确答案：D。原发性肝癌破裂

解析：肝癌患者，突发剧烈腹痛，出现休克，首先考虑肝癌结节破裂导致大出血所致出血性休克（D对）。原发性腹膜炎是指腹腔内无感染灶、没有与外界相通的损伤时所发生的腹膜炎，其中自发性细菌性腹膜炎最为常见，急性起病，有弥漫性腹痛，伴恶心呕吐、发热，有腹膜刺激征（A错）。急性梗阻性化脓性胆管炎以腹痛、发热、黄疸、感染性休克为主要临床表现（B错）。结核性腹膜炎是由结核杆菌引起的腹膜慢性、弥漫性炎症，临床以倦怠、发热、腹胀腹痛、畏寒、骤然高热、腹部包块为主要表现（C错）。肝性脑病为肝癌并发症，但见于肝癌终末期，起病可急可缓，多在黄疸出现后发生昏迷（E错）。